犬吠样咳嗽，可见于
A. 急性喉炎
B. 急性支气管炎
C. 支气管哮喘
D. 肺结核
E. 肺癌

正确答案：A。急性喉炎

解析：犬吠样咳嗽多见于喉头炎症（A对）水肿或气管受压。急性支气管炎（B错）表现为干咳且伴声音嘶哑。支气管哮喘（C错）表现为发作性带有哮鸣因的呼气性呼吸困难。肺结核（D错）患者咳嗽较轻，表现为干咳或少量黏液痰，若合并支气管结核，则表现为刺激性咳嗽。肺癌（E错）咳嗽常表现为无痰或少痰的刺激性干咳，多为持续性，呈高调金属音性咳嗽或刺激性呛咳。